左心功能不全肺循环淤血的主要临床表现，下列哪项不正确
A. 咳嗽咳痰，痰为浆液性，呈粉红色泡沫状
B. 劳力性呼吸困难，休息即缓解
C. 肺微小动脉压增高，血浆外渗，痰带血性
D. 阵发性夜间呼吸困难
E. 支气管痉挛，发作性哮喘

正确答案：C。肺微小动脉压增高，血浆外渗，痰带血性

解析：左心功能不全时，左心房压力升高，致使肺静脉和毛细血管淤血、毛细血管内压力过度升高可使毛细血管破裂，出现痰内带血丝（C错，为本题正确答案）。肺微小动脉破裂出血时，出血量较大，可见于支气管扩张症。左心功能不全时最早出现的症状就是劳力性呼吸困难，休息即缓解（B对）。左心功能不全加重，会导致夜间阵发性呼吸困难（D对），重者可有哮鸣音，称为“心源性哮喘”，其发生机制除睡眠平卧血液重新分配使肺血量增加外，有夜间迷走神经张力增加、小支气管收缩、横膈抬高、肺活量减少等因素，表现为广泛的湿啰音和哮鸣音（E对），易与支气管哮喘混淆。